与感觉功能有关的细胞是
A. 朗格汉斯细胞
B. 梅克尔细胞
C. 角质形成细胞
D. 组织细胞
E. 成纤维细胞

正确答案：B。梅克尔细胞

解析：口腔黏膜上皮的主要细胞是角质形成细胞，构成上皮的基本形态。除此细胞外，还有数种非角质形成细胞，其中之一是梅克尔细胞。梅克尔细胞位于口腔上皮的基底层。电镜观察见梅克尔细胞和进入上皮的神经末梢有突触连接，因此它是一种具有感觉功能的细胞。掌握“口腔黏膜基本结构”知识点。